催眠状态下的病人与医生间的医患关系属于
A. 主动—被动型
B. 指导—合作型
C. 共同参与型
D. 接近—疏远型
E. 以上都不是

正确答案：A。主动—被动型

解析：主动-被动型在这种医患关系中，医生是主动的，在病人心目中处于权威地位，而病人则处于被动的地位，对医疗过程和措施不提任何意见，完全按医生的要求去做，听从医生的支配。这种模式主要适用于昏迷、休克、全麻、有严重创伤及精神病人的医疗过程，这种病人或失去意识或不能表达自己的要求，只能听命于医生的安排。由于这一模式病人没有自由意志，对医务人员的职业道德和临床经验要求很高，医务人员必须仔细观察、认真操作，才不致对病人造成伤害。掌握“医患沟通的理论、技术与其应用以及医患关系模式”知识点。